1岁内婴儿乙肝疫苗接种时间为
A. 出生时、1个月、3个月
B. 出生时、1个月、6个月
C. 2个月、3个月、4个月
D. 3个月、4个月、5个月
E. 4个月、5个月、6个月

正确答案：B。出生时、1个月、6个月

解析：1岁内婴儿乙肝疫苗接种时间分别在出生时、1个月、6个月（B对AE错）。2个月、3个月、4个月（C错）是脊髓灰质炎三价混合疫苗的接种时间。3个月、4个月、5个月（D错）是百白破混合制剂的接种时间。